主要化学成分为四环三萜类化合物的药材是
A. 商陆
B. 蟾酥
C. 人参
D. 知母
E. 香加皮

正确答案：C。人参

解析：本题考查人参的主要化学成分及结构。人参（C对）《中国药典》以人参皂苷为指标成分对人参、红参和人参叶进行含量测定。人参皂苷可以分为三类，分别是人参皂苷二醇型（A型）、人参皂苷三醇型（B型）和齐墩果烷型（C型），A型、B型的皂苷元属于四环三萜，C型的皂苷元属于五环三萜。商陆（A错）的化学成分主要包括三萜及其皂苷类。《中国药典》以商陆皂苷甲（商陆皂苷A）为指标成分对商陆进行含量测定，含量不得少于0.15%。蟾酥（B错）《中国药典》以蟾毒灵、华蟾酥毒基和脂蟾毒配基为指标成分对蟾酥进行含量测定，要求总量不得少于7.0%。而蟾蜍甾二烯类母核具有α，β-；γ，δ-不饱和δ-内酯结构，和乙型强心苷一样不具有活性亚甲基反应。知母（D错）中的化学成分主要为甾体皂苷和芒果苷，还含有木脂素、甾醇、鞣质、胆碱等成分。《中国药典》上将知母皂苷BⅡ和芒果苷定为知母药材的质量控制成分，要求知母皂苷BⅡ含量不得少于3.0%，芒果苷的含量不得少于0.70%。香加皮（E错）中含有的强心苷类化合物为甲型强心苷，其中杠柳毒苷和杠柳次苷为其主要成分。